男，60岁，身高170cm，体重65kg。每日基础能量消耗约是
A. 1000kcal
B. 1200kcal
C. 1400kcal
D. 1600kcal
E. 1800kcal

正确答案：C。1400kcal

解析：Harris-Benedict公式是健康机体基础能量消耗（BEE）的估算公式。根据公式BEE（kcal/d）=66+13.8W+5.0H-6.8A〔W：体重（kg）；H：身高（cm）；A：年龄（年）〕可以计算出此人每日基础能量消耗约为1400kcal（C对）。需注意：每日基础能量消耗与实际能量需要的计算存在差异。每日基础能量消耗为BEE，需要运用公式进行计算。实际能量需要（每日所需基本热量）为REE，用20～25kcal/（kg·d）乘以体重进行计算。